疾病监测的主要目的是
A. 收集和分析健康资料
B. 确定致病因素和消灭传染源
C. 向政府有关部门报告某病的流行状况
D. 控制疾病

正确答案：D。控制疾病

解析：本题考查疾病监测的目的。疾病监测的目的：①确定主要的健康问题，掌握其分布和趋势；②查明原因，采取干预措施（D对ABC错）；③评价干预措施效果；④预测疾病流行；⑤制订公共卫生策略和措施。